容易引起Ⅱ型呼衰加重的药物是
A. 呼吸兴奋剂
B. 袢利尿剂
C. 强心剂
D. 镇静剂
E. 血管扩张剂

正确答案：D。镇静剂

解析：Ⅱ型呼吸衰竭即高碳酸性呼吸衰竭，血气分析特点为O₂分压下降、CO₂分压增加。若使用镇静剂，可加重CO₂潴留，从而加重Ⅱ型呼吸衰竭（D对）。对于Ⅱ型呼吸衰竭患者，呼吸兴奋剂在病人的气道通畅、呼吸肌功能基本正常等情况下可以使用，可增加肺通气，加快CO₂排除（A错）。袢利尿剂主要作用为利尿，对肺通气无影响（B错）。强心剂主要加强心肌收缩力，使心脏搏出量增加，对肺通气无影响（C错）。血管平滑肌扩张药（E错）对肺通气无显著影响。（九版药理学P224）包括主要扩张小动脉的药物，如肼屈嗪，使外周阻力下降而降低血压；还包括对小动脉和静脉均有扩张作用的药物，如硝普钠，使回心血量减少。